妇人宿有癥病，经断未及三月，而漏下不止，脐上有跳动者，治宜选用
A. 桂枝茯苓丸
B. 桂枝龙骨牡蛎汤
C. 当归散
D. 白术散
E. 胶艾汤

正确答案：A。桂枝茯苓丸

解析：妇女素有癥病，停经不到三个月，又漏下不止，并觉脐上似乎有胎动，其实这不是真正的胎动，而是癥积作祟，故曰“为癥痼害”。一般胎动均在受孕五个月左右出现，且此时其部位应在脐下，不会在脐上。如果怀孕六个月感觉有胎动，且停经前三个月月经正常，受孕后胞宫按月增大，当属胎孕。若前三个月经水失常、后三个月又经停不行，胞宫也未按月增大，复见漏下不止，这是癥痼造成的。宿有癥积，血瘀气滞，所以经水异常，渐至经停。瘀血内阻，血不归经，则漏下不止。癥积不去，漏下难止，宜消癥化瘀，使瘀去血止，用桂枝茯苓丸治疗（A对）。